下面哪种细胞不参与支气管哮喘的炎症反应
A. 嗜酸性粒细胞
B. 嗜碱性粒细胞
C. 中性粒细胞
D. 肥大细胞
E. T淋巴细胞

正确答案：B。嗜碱性粒细胞

解析：支气管哮喘，简称哮喘，是由多种细胞（如嗜酸性粒细胞、肥大细胞、T细胞、中性粒细胞、气道上皮细胞）和细胞组分参与的气道慢性炎症性疾病。这种气道慢性炎症也被认为是哮喘的表现。掌握“支气管哮喘”知识点。